分布于胸腔脏器的交感神经节后纤维发自
A. 颈交感干神经节
B. 胸第1-5交感干神经节
C. 颈、胸交感干神经节
D. 胸交感干神经节
E. 骶、尾交感干神经节

正确答案：D。胸交感干神经节

解析：颈交感干神经节（A错）发出节后纤维分布于头颈部。胸交感干神经节（D对）分布于胸腔脏器。胸第1-5交感干神经节（B错）参加胸主动脉丛、食管丛、肺丛及心丛等。